阴部内动脉
A. 来源于髂外动脉
B. 经梨状肌上孔出骨盆
C. 行经坐骨棘前面
D. 经坐骨小孔至坐骨肛门窝
E. 分支布于肛管、会阴、外生殖器

正确答案：D。经坐骨小孔至坐骨肛门窝

解析：阴部内动脉来源于髂内动脉（A错）。穿梨状肌下孔（B错）出骨盆。继经坐骨小孔至坐骨肛门窝（D对）。阴部内动脉发出肛动脉、会阴动脉和阴茎背动脉（阴蒂背动脉），分布于肛门、会阴部和外生殖器（E错）。